男，1岁。头发稀黄，皮肤白嫩，头不能竖起，间断抽搐。尿有鼠尿味。该患儿的诊断是
A. 先天愚型
B. 呆小病
C. 先天性脑发育不全
D. 苯丙酮尿症
E. 脑性瘫痪

正确答案：D。苯丙酮尿症

解析：诊断是苯丙酮尿症的原因是：患儿出现明显鼠尿臭味，头发稀黄，皮肤白嫩，间断抽搐，符合苯丙酮尿症（D对）的临床表现。患儿没有出现智能落后、生长发育迟缓（P431）和生理功能低下的呆小症（B错）的临床表现。先天愚型（A错）、先天性脑发育不全（C错）、脑性瘫痪（E错）不会出现因黑色素合成不足所致的头发稀黄，皮肤白嫩，也不会出现因尿液和汗液中排出苯乙酸所致的鼠尿臭味。